高效抑菌药是
A. 头孢菌素
B. 氯霉素
C. 磺胺嘧啶
D. 异烟肼
E. 庆大霉素

正确答案：C。磺胺嘧啶